急性小肠扭转一般应及时手术治疗，因为其易发生
A. 麻痹性肠梗阻
B. 单纯性肠梗阻
C. 痉挛性肠梗阻
D. 绞窄性肠梗阻
E. 机械性肠梗阻

正确答案：D。绞窄性肠梗阻

解析：肠扭转是闭袢型肠梗阻加绞窄性肠梗阻（D对），发病急骤，发展迅速。起病时腹痛剧烈且无间歇期，早期即可出现休克。及时地手术治疗，将扭转的肠袢回转复位可降低死亡率，更可减少小肠大量切除后的短肠综合征。